胆汁中胆汁酸盐在消化道的主要作用是
A. 促进蛋白质吸收
B. 促进核酸吸收
C. 促进脂质吸收
D. 促进矿物质吸收
E. 促进维生素吸收

正确答案：C。促进脂质吸收

解析：本题考查胆汁酸盐在消化道的作用。胆汁中胆汁酸盐在消化道的主要作用是促进脂质吸收（C对）。胆汁酸有助于脂肪的乳化，增强胰腺的脂解作用，并通过形成混合胶粒提高脂类的溶解度，促进肠道对脂类物质的吸收。